菌斑成熟的关键成分是
A. 葡糖醛酸
B. 蔗糖
C. 葡聚糖
D. 果糖
E. 葡糖基转移酶

正确答案：C。葡聚糖

解析：本题考查菌斑成熟的关键成分。菌斑成熟的关键成分是葡聚糖（C对）。菌斑的基质由细菌利用蔗糖合成葡聚糖而成，而一些细菌表面结合的葡糖基转移酶（GTF）对葡聚糖有很强的亲和力，从而形成细菌集聚的基础。菌斑成熟的关键成分是葡聚糖在细菌与牙面，细菌与细菌之间起桥梁作用，促进细菌对牙面获得膜的黏附和细菌间的集聚。成熟的菌斑结构致密，渗透性减弱，成为相对独立的微生态环境，有利于细菌产酸，不利于酸的扩散和清除。牙菌斑是细菌生长、繁殖、代谢和衰亡的微生态环境，细菌只有形成牙菌斑才能致龋。因此，牙菌斑是龋病发生的始动因子。